关于卵巢性激素正确的是
A. 孕激素使子宫颈粘液分泌增加，性状变稀薄
B. 雄激素主要由颗粒细胞分泌，促进乳房发育
C. 孕激素有促进水钠潴留作用，雌激素则促进水钠排泄
D. 雌激素使增生期子宫内膜转化为分泌期内膜
E. 孕激素可使基础体温在排卵后升高0.3℃~0.5℃

正确答案：E。孕激素可使基础体温在排卵后升高0.3℃~0.5℃

解析：雌激素：由颗粒细胞分泌，促进子宫内膜腺体和间质增生，使子宫颈粘液分泌增加，性状变稀薄，促进水钠潴留。孕激素：使增殖期子宫内膜转化为分泌期内膜（D错），使黏液分泌减少，性状变黏稠（A错），促进水钠排泄（C错），使基础体温在排卵后升高0.3℃～0.5℃（E对）；雄激素（睾酮）主要由卵巢间质细胞分泌（B错）。